属于肝硬化雌激素增多的是
A. 蜘蛛痣
B. 脾肿大
C. 黄疸
D. 水肿
E. 肝肿大

正确答案：A。蜘蛛痣

解析：肝功能减退时，对内分泌激素灭能作用减弱，产生各种内分泌代谢紊乱，主要有雌激素、醛固酮及抗利尿激素增多，当肝功能损害严重时，蜘蛛痣的数目可增多、增大，肝功能好转则可减少、缩小或消失（A对）。脾肿大是门静脉高压的表现（B错）。黄疸经久不愈可转化为肝硬化（C错）。水肿与题目无关（D错）。肝肿大为肝硬化但代偿期的表现（E错）。